属于非经胃肠道给药的制剂是
A. 维生素C片
B. 西地碘含片
C. 盐酸环丙沙星胶囊
D. 布洛芬混悬滴剂
E. 氯雷他定糖浆

正确答案：B。西地碘含片

解析：本题考查非经胃肠道给药的剂型。西地碘含片（B对）属于含片，为非经胃肠道给药的剂型，可以不经过胃肠道即发挥药物作用。非经肠道给药剂型是指除胃肠道给药途径以外的其它所有剂型，包括注射给药、皮肤给药、口腔给药（如漱口剂、含片、舌下片剂、膜剂等）、鼻腔给药、肺部给药、眼部给药、直肠、阴道和尿道给药等。经胃肠道给药剂型是指给药后药物经胃肠道吸收后发挥疗效。如溶液剂、糖浆剂、颗粒剂、胶囊剂、散剂、丸剂、片剂等。维生素C片（A错）为片剂，盐酸环丙沙星胶囊（C错）为胶囊剂，布洛芬混悬滴剂（D错）为混悬剂，氯雷他定糖浆（E错）为糖浆剂，均属于经胃肠道给药的剂型，可以口服给药。